依据《医疗器械说明书、标签和包装标识管理规定》，医疗器械说明书、标签和包装标识不得含有的内容有
A. “保证治愈”“即刻见效”“疗效最佳”等表示功效的断言或保证的内容
B. 说明治愈率或者有效率的内容
C. 禁忌症、注意事项及需要警示或提示的内容
D. 限期使用产品的内容
E. 与其他企业产品的功效和安全性相比较的内容

正确答案：A、B、E。“保证治愈”“即刻见效”“疗效最佳”等表示功效的断言或保证的内容；说明治愈率或者有效率的内容；与其他企业产品的功效和安全性相比较的内容

解析：本题考查医疗器械说明书和标签。医疗器械说明书和标签不得有下列内容：①含有“疗效最佳”“保证治愈”“包治”“根治”“即刻见效”“完全无毒副作用”等表示功效的断言或者保证的（A对）；②含有“最高技术”“最科学”“最先进”“最佳”等绝对化语言和表示的；③说明治愈率或者有效率的（B对）；④与其他企业产品的功效和安全性相比较的（E对）；⑤含有“保险公司保险”“无效退款”等承诺性语言的；⑥利用任何单位或者个人的名义、形象作证明或者推荐的；⑦含有误导性说明，使人感到已经患某种疾病，或者使人误解不使用该医疗器械会患某种疾病或者加重病情的表述，以及其他虚假、夸大、误导性的内容；⑧法律、法规规定禁止的其他内容。